消风散的君药是
A. 荆芥、防风、牛蒡子、蝉蜕
B. 银花、连翘、栀子
C. 苍术、苦参、木通
D. 知母、石膏
E. 生甘草

正确答案：A。荆芥、防风、牛蒡子、蝉蜕

解析：消风散的君药是荆芥、防风、牛蒡子、蝉蜕之辛散透达，疏风散邪，使风去则痒止（A对）。消风散中没有银花、连翘、栀子三味药（B错）。苍术祛风燥湿、苦参清热燥湿、木通渗利湿热，为湿邪而设，共为臣药（C错）。知母、石膏清热泻火，是为热邪而用，共为臣药（D错）。生甘草清热解毒，和中调药，为使药（E错）。